可摘局部义齿基牙观测时，三型观测线为
A. 近缺隙侧倒凹区小，远离缺隙侧倒凹区大
B. 近缺隙侧倒凹区大，远离缺隙侧倒凹区也小
C. 近缺隙侧倒凹区大，远离缺隙侧倒凹区不变
D. 近缺隙侧倒凹区大，远离缺隙侧倒凹区也大
E. 近缺隙侧与远离缺隙侧均无倒凹区

正确答案：D。近缺隙侧倒凹区大，远离缺隙侧倒凹区也大

解析：三型观测线：基牙的远、近缺隙侧均有明显的倒凹或基牙向颊舌侧倾斜时所形成的观测线，观测线在近缺隙侧和远缺隙侧距（牙合）面都近，倒凹区都较大，非倒凹区小。掌握“局部义齿类型，肯氏分类及模型观测”知识点。